有关牙髓细胞间质包括
A. 基质
B. 纤维
C. 血管
D. 淋巴管
E. 以上均包括

正确答案：E。以上均包括

解析：牙髓的细胞间质包括纤维、基质、血管、淋巴管和神经等。掌握“牙髓”知识点。